肖某，女性，39岁。小便黄赤灼热，尿血鲜红，心烦口渴，面赤口疮，夜寐不安，舌红脉数，治疗应选用
A. 知柏地黄丸
B. 归脾汤
C. 小蓟饮子
D. 八正散
E. 无比山药丸

正确答案：C。小蓟饮子

解析：湿热下注膀胱，热伤血络，迫血妄行，故见小便黄赤灼热，尿血鲜红；心火亢盛则见心烦口渴，面赤口疮等实热之象；热扰心神则夜寐不安；舌红脉数为血淋实证的表现，治疗需清热利湿，凉血止血，方药选用小蓟饮子加减（C对）。知柏地黄丸（A错）可以滋阴降火，凉血止血，用于治疗血淋虚证。归脾汤（B错）可以健脾养心，补益气血，用于治疗劳淋。八正散（D错）可以清热利湿通淋，用于治疗热淋。无比山药丸（E错）可以补脾益肾，用于治疗劳淋。